丹参醌ⅡA的结构类型是
A. 苯醌类
B. 萘醌类
C. 蒽醌类
D. 菲醌类
E. 蒽酮类

正确答案：D。菲醌类

解析：本题考查的是醌类化合物的分类。丹参醌ⅡA的结构类型是菲醌类（D对）。醌类化合物从结构上分主要有苯醌、萘醌、菲醌、蒽醌等四类。1.苯醌类（A错）：苯醌类化合物从结构上可分为邻苯醌和对苯醌两大类。从中药软紫草中分得的一些物质属于对苯醌类化合物。2.萘醌类（B错）：许多萘醌类化合物具有明显的生物活性，如从中药紫草及软紫草中分得的一系列紫草素及异紫草素衍生物，可认为这些萘醌化合物为紫草的有效素成分。3.菲醌类：天然菲醌类衍生物包括邻醌及对醌两种类型。如从中药丹参根中提取的丹参醌Ⅰ、丹参醌ⅡA、丹参醌ⅡB、隐丹参醌等。4.蒽醌类（C错）：蒽醌类成分包括蒽酮及其不同还原程度的产物。按母核可分为单蒽核及双蒽核，按氧化程度又可分为氧化蒽酚、蒽酮（E错）、蒽酚及蒽酮的二聚物。